我国基本国策
A. 精子与卵子结合
B. 受精卵女性子宫内孕育成胚胎、胎儿直至分娩的整个过程，即是生育的全过程
C. 胎儿娩出后母亲要哺乳，保证新生儿正常发育成长
D. 计划生育既要控制人口数量，又要提高人口素质
E. 计划生育只要控制人口数量

正确答案：D。计划生育既要控制人口数量，又要提高人口素质

解析：本题考查我国的基本国策。我国的基本国策：计划生育既要控制人口数量，又要提高人口素质（D对ABCE错），主要内容及目的是：提倡晚婚、晚育，少生、优生，从而有计划地控制人口。